有关硬腭的形成，下面描述错误的是
A. 侧腭突同时参与了第一硬腭和第二硬腭的形成
B. 第一硬腭由中鼻突生长发育而成
C. 硬腭由第一硬腭和第二硬腭融合而成
D. 第二硬腭由侧腭突生长发育而成
E. 侧腭突不能融合则形成腭裂

正确答案：A。侧腭突同时参与了第一硬腭和第二硬腭的形成

解析：本题考查腭的发育。有关硬腭的形成，下面描述错误的是侧腭突同时参与了第一硬腭和第二硬腭的形成（A错，为本题正确答案）。硬腭的发育：腭指介于口腔和鼻腔之间的组织。胚胎早期原始鼻腔和口腔是彼此相通的，腭的发育使口腔与鼻腔分开。在上颌骨弓出现后，约第8周末由两侧的上颌突的内侧面向中央长出一个侧腭突，其前半部分形成骨板，两侧融合而形成第二硬腭，并与中鼻突形成的第一硬腭融合形成整个硬腭部。